十五络脉是指十四经络脉加
A. 胃之络
B. 脾之络
C. 胃之大络
D. 脾之大络
E. 虚里之脉

正确答案：D。脾之大络

解析：该题考查十五络脉的定义，属记忆内容。十五络脉为十二经脉、任督二脉外加脾之大络（D对ACDE错）。